高血压合并Ⅱ度房室传导阻滞不宜选用的药物是
A. 缬沙坦
B. 美托洛尔
C. 贝那普利
D. 氢氯噻嗪
E. 硝苯地平控释片

正确答案：B。美托洛尔

解析：高血压合并Ⅱ度房室传导阻滞不宜选用的药物是美托洛尔（B对），β受体拮抗剂对心肌收缩力、窦房结及房室结功能均有抑制作用。缬沙坦（A错）主要作用为交感神经抑制剂。贝那普利（C错）为血管紧张素转化酶抑制剂，主要通过抑制循环和组织ACE。氢氯噻嗪（D错）为利尿剂，通过排钠，减少细胞外容量，降低外周血管阻力。硝苯地平控释片（E错）为钙通道阻滞剂，通过减弱兴奋-收缩偶联，降低阻力血管的收缩。